（133～134题共用题干）男，35岁。尿频、尿急、尿痛及右侧阴囊肿痛6个月。既往有肺结核病史。查体：右侧附睾尾部肿大、质硬。首先应该考虑的疾病是
A. 急性附睾炎
B. 慢性附睾炎
C. 肾结核
D. 膀胱炎
E. 附睾结核

正确答案：E。附睾结核

解析：患者既往有肺结核病史，且查体：右侧附睾尾部肿大、质硬（附睾结核病变常从附睾尾开始，呈干酪样变、脓肿及纤维化），所以首先应考虑附睾结核（E对）。肾结核（C错）较大肾积脓或对侧巨大肾积水时，在腰部可触及肿块（P545）。急性细菌性膀胱炎病人常诉排尿时尿道有烧灼感，甚至不敢排尿。常见终末血尿，有时为全程血尿，甚至有血块排出（P537），慢性细菌性膀胱炎（D错）有耻骨上膀胱区不适，膀胱充盈时疼痛较明显，尿液浑浊（P538）。急性附睾炎（A错）发病突然，全身症状明显，可有畏寒、高热（P542）。慢性附睾炎（B错）临床表现为阴囊有轻度不适，或坠胀痛，休息后好转（P542）。